胃的血管不包括
A. 胃左动脉是腹腔动脉的分支
B. 胃后动脉经腹膜后到胃底
C. 胃右动脉是脾动脉的分支
D. 胃网膜左、右动脉在胃大弯侧吻合
E. 胃短动脉经胃脾韧带到胃底

正确答案：C。胃右动脉是脾动脉的分支

解析：胃左动脉是腹腔动脉的分支（A对）。胃后动脉经腹膜后到胃底（B对）。胃右动脉是肝总动脉（C错，为本题正确答案）的分支。胃网膜左、右动脉在胃大弯侧吻合（D对）。胃短动脉经胃脾韧带到胃底（E对）。